AIDS窗口期是指
A. 感染者体内有HIV存在并具有感染性，但血清中尚不能检测到HIV抗体
B. 感染者体内有HIV存在，但尚无任何临床表现
C. 感染者体内有HIV存在，但尚无传染性
D. 感染者体内有FIIV存在，但无感染性，血清中也不能检测到HIV抗体
E. 感染者体内有HIV存在，在血清中也能检测到HIV抗体

正确答案：A。感染者体内有HIV存在并具有感染性，但血清中尚不能检测到HIV抗体